唾液维持口腔pH值是由于唾液的
A. 消化作用
B. 清洁作用
C. 缓冲作用
D. 保护作用
E. 稀释作用

正确答案：C。缓冲作用

解析：消化作用：唾液内的淀粉酶，能分解食物中的淀粉成麦芽糖。这不仅在口腔内进行，当由唾液混合的食团进入胃后，在未接触胃酸前，唾液淀粉酶似可继续作用约30分钟，直至胃内物变为pH约为4.5的酸性反应为止。pH=6时，唾液淀粉酶最宜发挥作用。稀释和缓冲作用：唾液可以缓冲口腔内的酸碱度；若刺激性很强的物质进入口内，唾液分泌立即增多，以稀释其浓度。过冷过热的温度等刺激也可借以缓冲，以保护口腔组织。唾液维持口腔pH值是由于唾液的缓冲作用。掌握“唾液的分泌和功能”知识点。